诊断慢性胃炎最可靠的依据是
A. 慢性上腹部疼痛
B. 胃酸降低
C. X线钡餐检查
D. 胃脱落细胞检查
E. 胃镜检查及胃黏膜活检

正确答案：E。胃镜检查及胃黏膜活检